在感染过程的5种结局中最不常见的表现是
A. 病原体被清除
B. 隐性感染
C. 显性感染
D. 病原携带状态
E. 潜伏性感染

正确答案：C。显性感染

解析：感染过程有五种不同结局，包括：病原体被清除、隐性感染、显性感染、病原携带状态和潜伏性感染，其中显性感染（C对）即指临床上出现某一传染病所特有的综合征，最少见，隐性感染（B错）是指只能通过免疫学检查才能发现，最常见。病原携带状态（D错）是指人体不出现临床症状；潜伏性感染（E错）是由于机体免疫功能足以将病原体局限化而不引起显性感染；病原体被清除（A错）是指病原体进入人体后，可被机体非特异性防御能力所清除，均较常见。